肾癌患者出现血尿时肿瘤已
A. 累及肾包膜
B. 转移至膀胱
C. 累及肾周脂肪囊
D. 血行转移
E. 侵及肾盂肾盏

正确答案：E。侵及肾盂肾盏

解析：当肾癌患者出现血尿时，表明肿瘤已侵及肾盂肾盏（E对）。肾癌累及肾包膜（A错）、肾周脂肪囊（C错）时，可出现腰部钝痛或隐痛。肾癌可经血液转移（D错）至肺、肝、骨、脑等部位，出现咳嗽、咯血、转移部位疼痛、病理骨折及神经麻痹等表现。肾癌转移至膀胱（B错）可出现血尿，但出现血尿时不一定表明肿瘤已转移至膀胱。